患者，男，70岁，右手抖动和行走缓慢3个月，经过神经科检查后诊断为帕金森病。既往前列腺肥大史3年，临床上对该患者不宜选用
A. 苯海索
B. 左旋多巴
C. 多巴丝肼
D. 司来吉兰
E. 金刚烷胺

正确答案：A。苯海索

解析：本题考查抗帕金森病用药。苯海索（A错，为本题正确答案）为抗胆碱能类抗抑郁药，可使膀胱逼尿肌松弛，引起小便不畅，甚至尿潴留，因此前列腺肥大患者禁用。抗帕金森病药包括复方左旋多巴如左旋多巴（B对）、多巴丝肼（C对）；MAO-B抑制剂司来吉兰（D对）；促多巴胺释放药金刚烷胺（E对）等。